肺病取中府肺俞，其配穴方法是
A. 前后配穴
B. 表里配穴
C. 左右配穴
D. 上下配穴
E. 本经配穴

正确答案：A。前后配穴

解析：前后配穴法是指将人体前部和后部的腧穴配合应用的方法，主要指将胸腹部和背腰部的腧穴配合应用。中府位于胸部横平第1肋间隙，锁骨下窝外侧，正中线旁开6寸，肺俞为肺之背俞穴，在脊柱区，第3胸椎棘突下，后正中线旁开1.5寸，治疗肺病前取中府，后取肺俞，为前后配穴法（A对）。表里经配穴法是以脏腑、经脉的阴阳表里配合关系为依据的配穴方法（B错）。左右配穴法是指将人体左侧和右侧的腧穴配合应用的方法（C错）。上下配穴法是指将腰部以上或上肢腧穴和腰部以下或下肢腧穴配合应用的方法（D错）。本经配穴法是当某一脏腑、经脉发生病变时，即选该脏腑、经脉的腧穴配成处方的配穴方法（E错）。